男性，40岁，患十二指肠溃疡，择期经上腹正中切口行胃大部切除术，并置切口内乳胶片引流正常情况下，该患者拆线时间应为术后
A. 3～4天
B. 5～6天
C. 7～9天
D. 10～12天
E. 12天以上

正确答案：C。7～9天

解析：缝线的拆除时间，可根据切口部位、局部血液供应情况、病人年龄、营养状况等来决定。正常情况下，拆线时间如下：头、面、颈部术后4～5日拆线；下腹部、会阴部术后6～7日拆线；胸部、上腹部、背部、臀部术后7～9日拆线；四肢手术10～12日拆线（近关节处可适当延长）；减张缝线14日拆线。患者手术切口位于上腹部，故正常情况下其拆线时间为术后7～9天（C对）。